某市8岁正常男孩体重均有95%的人在18.39～29.45公斤，其标准差是
A. 2.14
B. 5.14
C. 2.82
D. 0.95
E. 无法计算

正确答案：C。2.82

解析：参考值范围又称正常值范围：医学上常把绝大多数正常人的某指标值范围称为该指标的正常值范围。
对于正态分布资料，计算95%的正常值范围的公式为：均数±1.96×标准差。
本题中该市8岁正常男孩体重95%正常值范围是18.39～29.45公斤，所以：
均数＋1.96×标准差＝29.45；
均数－1.96×标准差＝18.39；
把两式相减，得到：1.96×标准差＋1.96×标准差＝29.45－18.39；
3.92×标准差＝11.06；标准差＝2.82。掌握“定量资料的统计描述和推断”知识点。